回肠及部分空肠切除术后出现腹泻，每日10余次稀水样便，进食后加剧。腹泻原因主要是
A. 肠道感染
B. 分泌增加
C. 消化不良
D. 吸收不良
E. 肠蠕动加快

正确答案：D。吸收不良

解析：该患者于回肠及部分空肠切除术（短肠综合征常见病因）后出现腹泻，每日10余次稀水样便，进食后加剧（短肠综合征常见的最初症状）。结合患者病史和症状，考虑诊断为短肠综合征。小肠是食物吸收的主要部位，正常人小肠的吸收功能有很大的储备，当超过50%或以上的小肠被切除时可引起吸收不良，最初的症状主要表现为腹泻（D对）。肠道感染后可出现腹泻的症状，但除此之外还可表现为发热、腹痛等（A错）。患者切除回肠及部分空肠后，由于分泌腺体减少，导致小肠分泌减少（B错）。消化道的消化功能主要取决于胃、肝脏和胰腺所分泌的消化液（C错），经消化液充分消化后的食物经十二指肠和空肠吸收。